男，68岁。皮肤及巩膜黄染2周，无腹痛及发热。查体：皮肤巩膜明显黄染，右上腹可触及肿大的胆囊，张力高，无压痛。最可能的诊断是
A. 胆管结石
B. 肝癌
C. 慢性胰腺炎
D. 胆囊结石
E. 胰头癌

正确答案：E。胰头癌

解析：老年患者，无痛性黄疸，右上腹可触及无痛性肿大胆囊（Courvoisier征，胰头癌典型体征），最可能的诊断是胰头癌（E对）。胆管结石（A错）平时无症状或仅有上腹不适，当胆管造成梗阻时，可出现腹痛和黄疸；肝癌（B错）常表现为肝区疼痛、黄疸、右上腹疼痛；慢性胰腺炎（C错）主要表现为腹痛、糖尿病及脂肪泻；胆囊结石（D错）主要表现为饱餐后阵发性右上腹绞痛，黄疸少见。需注意：无痛性肿大胆囊为胰头癌、壶腹周围癌的典型体征。